脏腑关系中，“燥湿相济”说的是哪种关系
A. 心与小肠
B. 肝与胆
C. 脾与胃
D. 肺与大肠
E. 肾与膀胱

正确答案：C。脾与胃

解析：脾为阴脏，主运化水饮，喜燥而恶湿；胃为阳腑，主通降下行，喜润而恶燥。脾易生湿，得胃阳以制之，使脾不至于湿；胃易生燥，得脾阴以制之，使胃不至于燥。脾胃阴阳燥湿相济，是保证两者纳运、升降协调的必要条件（C对）。